下列属于负反馈的是
A. 排尿反射
B. 体温调节
C. 血液凝固
D. 排便反射
E. 分娩

正确答案：B。体温调节